关于牙齿平滑面龋的叙述，下列错误的是
A. 邻面龋的早期表现X线显示不明显
B. 早期平滑面龋表现为白垩色斑块
C. 颊舌面颈部龋外观与邻面龋相似
D. 颊舌面龋为隐匿性龋，没有开放龋洞
E. 早期龋损探诊质硬、光滑

正确答案：D。颊舌面龋为隐匿性龋，没有开放龋洞

解析：早期平滑面龋表现为牙表面白垩色不透明区，釉质表面的连续性未丧失，探针探诊时釉质仍质硬、光滑，常规X线摄影也不能检测到病变。以后病变向周围组织扩展，逐渐变得粗糙，最终病变进展，组织崩溃，龋洞形成。颊舌面颈部龋外观与邻面龋相似，但多数形成开放的龋洞。掌握“牙釉质龋”知识点。